常用而可靠的止血
A. 指压止血
B. 包扎止血法
C. 填塞止血法
D. 结扎止血法
E. 药物止血法

正确答案：D。结扎止血法

解析：结扎止血法是常用而可靠的止血方法。如条件许可，对于创口内出血的血管断端都应用止血钳夹住，作结扎或缝扎止血。在紧急情况下，也可先用止血钳夹住血管断端，连同止血钳一起妥善包扎后送医院。口腔颌面部较严重的出血如局部不能妥善止血时，可结扎颈外动脉。掌握“口腔颌面部创伤急救”知识点。